下述何种药物用于高血危象
A. 依那普利
B. 氢氯噻嗪
C. 哌唑嗪
D. 硝普钠
E. 普萘洛尔

正确答案：D。硝普钠